前置胎盘时的阴道流血特征是
A. 阴道流血常有外伤史
B. 子宫收缩时阴道流血停止
C. 无痛性阴道流血
D. 有痛性阴道流血
E. 阴道流血量与贫血严重程度不相符

正确答案：C。无痛性阴道流血

解析：前置胎盘的典型症状为妊娠晚期或临产时，发生无诱因、无痛性反复阴道流血，（C对D错）；胎盘早剥典型症状为妊娠中期突发持续性腹痛，伴或不伴阴道流血，贫血程度与阴道流血量不符，且常有外伤史，ADE均为胎盘早剥的特点（ADE错）。妊娠35周以后，子宫生理性收缩频率增加，前置胎盘出血率随之上升（P128）（B错）。